肺心病患者出现心室颤动心脏骤停以致突然死亡最常见的原因是
A. 急性广泛心肌梗死
B. 急性严重心肌缺氧
C. 右心功能不全
D. 左心功能不全
E. 合并脑血管意外

正确答案：B。急性严重心肌缺氧

解析：肺心病患者体内出现低氧血症和高碳酸血症，冠脉血供不足，急性严重心肌缺氧（B对），出现心室颤动、心脏骤停以致突然死亡。急性广泛心肌梗死（A错）多由冠脉病变，血栓形成继而闭塞、痉挛导致，不是肺心病患者常见并发症。肺心病患者因肺循环阻力增加导致肺动脉高压，为克服升高的肺动脉阻力而发生右心肥厚，进而出现右心功能不全（C错），如病情进展，可出现左心功能不全（D错），但都不是肺心病患者出现心室颤动心脏骤停以致突然死亡最常见的原因。肺心病患者合并脑血管意外（E错）少见，不是出现心室颤动心脏骤停以致突然死亡最常见的原因。